以脘腹胀闷，泛恶欲呕，腹痛便溏身重为特征的证候是
A. 脾不统血证
B. 脾虚气陷证
C. 寒湿困脾证
D. 脾阳虚证
E. 脾气虚证

正确答案：C。寒湿困脾证

解析：寒湿内盛，脾阳受困，运化失职，则脘腹痞胀而痛；脾失健运，水湿下渗，则大便稀溏；脾失健运，影响胃失和降，胃气上逆，故泛恶欲欧；湿性重浊，泛溢肢体，遏郁清阳，则头身困重（C对）。不统血证以各种慢性出血与气血亏虚症状为主要表现无下陷症状（A错）。脾虚气陷证以脘腹重坠、内脏下垂与气虚症状为主要表现（B错）。脾阳虚证以食少、腹胀腹痛、便溏与虚寒症状为主要临床表现（D错）。脾气虚证以食少、腹胀、便溏与气虚症状为主要临床表现（E错）。